体内总清除率的计算公式是
A. V=X/C
B. C=C₀e⁻kt
C. Cl=KV
D. t½=0.693/K
E. Css=K₀/KV

正确答案：C。Cl=KV

解析：本题考查的是药物动力学公式。体内总清除率的计算公式是Cl=KV（C对）。表观分布容积计算公式V=X/C（A错）。单室模型单剂量静脉注射给药，血药浓度与时间关系的计算公式是C=C₀e⁻kt（B错）。当药物在室温下降解50%所需时间为半衰期（t1/2），其计算公式为t1/2=0.693/K（D错）。单室模型静脉滴注给药稳态血药浓度公式为Css=K₀/KV（E错）。